下列关于隐性唇裂的叙述中，正确的是
A. 下方的肌层未能联合或错位联合
B. 皮肤和黏膜无裂开
C. 患侧可出现浅沟状凹陷
D. 患侧可出现唇峰分离
E. 以上均正确

正确答案：E。以上均正确

解析：临床上还可见到隐性唇裂，即皮肤和黏膜无裂开，但其下方的肌层未能联合或错位联合，致患侧出现浅沟状凹陷及唇峰分离等畸形。掌握“唇裂”知识点。